关于表面活性剂的叙述中哪一条是正确的
A. 能使溶液表面张力降低的物质
B. 能使溶液表面张力增加的物质
C. 能使溶液表面张力不改变的物质
D. 能使溶液表面张力急剧下降的物质
E. 能使溶液表面张力急剧上升的物质

正确答案：D。能使溶液表面张力急剧下降的物质

解析：本题考查表面活性剂。表面活性剂系指具有很强的表面活性、加入少量就能使液体的表面张力显著下降的物质（D对）。